对慢性疾病进行现况调查，最适宜计算的指标为
A. 罹患率
B. 发病率
C. 患病率
D. 感染率
E. 发病比

正确答案：C。患病率

解析：对慢性疾病进行现况调查，最适宜计算的指标为患病率（C对）。罹患率（A错）（P28）与发病率一样，也是测量人群新病例发生的指标，但是适用于小范围短时间内疾病频率的测量。发病率（B错）（P28）表示的是在一定期间内，特定的人群中某病的新发病例出现的频率，也可叫做发病比（E错）。感染率（D错）是指某个时间内被检查的人群中，某病现有感染者人数所占的比例。